GH兴奋试验有助于明确病因诊断的情况是
A. 身材矮小
B. 身材高大
C. 消瘦
D. 肥胖
E. 肢端肥大

正确答案：A。身材矮小

解析：GH兴奋试验适用于生长激素分泌减少的情况，用来估计生长激素的贮备功能，身材矮小（A对）是生长激素分泌不足引起的症状，可作GH兴奋试验。而身材高大（B错）、肢端肥大（E错）是生长激素分泌过多导致的症状，应做GH抑制试验；消瘦（C错）、肥胖（D错）与生长激素关系不大。